男，30岁。上腹痛7天，餐后突然加剧6小时，并很快波及全腹。既往有胃病史。当时查体：全腹压痛，反跳痛，肌紧张，肝浊音界消失，肠鸣音减弱。入院后最可能的诊断
A. 急性阑尾炎穿孔
B. 胃十二指肠溃疡穿孔
C. 绞窄性肠梗阻
D. 急性胆囊炎穿孔
E. 急性出血性胰腺炎

正确答案：B。胃十二指肠溃疡穿孔

解析：男性青年患者，上腹痛7天，餐后加剧6小时，并很快波及全腹（上腹痛，饱餐等诱因后转移为全腹痛）。既往有胃病史（考虑是否有胃十二指肠溃疡），当时查体：全腹压痛，反跳痛，肌紧张，肠鸣音减弱（考虑为由胃十二指肠穿孔所引起的急性腹膜炎），肝浊音界消失（考虑为胃十二指肠穿孔所引起的腹腔积气所致）。综合病人的病史、查体，入院后最可能的诊断为胃十二指肠溃疡穿孔（B对）。急性阑尾炎（A错）典型表现为转移性右下腹痛，腹痛部位常始于上腹、脐周，而后转移至右下腹疼痛，体检右下腹有明显压痛。绞窄性肠梗阻（C错）典型表现为主要表现为“痛”、“吐”、“胀”、“停”。即腹痛，恶心、呕吐，腹胀，停止自肛门排气排便。急性胆囊炎穿孔（D错）典型表现为上腹部疼痛，疼痛放射到右肩、肩胛和背部，随后腹痛可波及至全腹。体检右上腹胆囊区域有明显压痛，Murphy征阳性，发生穿孔后可出现弥漫性腹膜炎表现，但查体不会有肝浊音界消失。急性出血（E错）典型表现为病人出现呕血或者黑便，严重时可能出现失血休克症状，与题干中病人所出现症状明显不符。